患者，女，26岁。非周期性子宫出血，量多、色紫红、质稠，夹有血块，腹痛拒按，舌红苔黄，脉弦数。治疗除取关元、三阴交、隐白穴外，还应加
A. 气海、百会
B. 中极、阴交
C. 归来、合谷
D. 血海、水泉
E. 曲泉、血海

正确答案：D。血海、水泉

解析：患者年轻女患者，非周期性子宫出血为崩漏；其量多、色紫红、质稠，夹有血块，腹痛拒按，舌脉亦是佐证，当为实热。故应加血海、 水泉，可泄血中之热，以止血热之妄行（D对）。气海、百会可扶元气，而收回阳固脱之功，适用于虚脱者（A错）。中极、阴交无泻血中之热的功效（B错）。归来、合谷非止血崩之穴（C错）。曲泉可治月经不调，但非止血崩之穴（E错）。